疖肿此愈彼起，不断发生，伴口干唇燥，舌质红，苔薄，脉细数。应首选
A. A仙方活命饮合增液汤
B. 五神汤合参苓白术散
C. 五味消毒饮
D. 清暑汤
E. 竹叶黄芪汤

正确答案：A。A仙方活命饮合增液汤

解析：疖肿此愈彼起，不断发生，伴口干唇燥，可辨证为体虚毒恋，阴虚内热证；舌质红，苔薄，脉细数为阴虚内热的征象。治宜养阴清热解毒，代表方为仙方活命饮合增液汤加减（A对）。疖肿分为四个证型，热毒蕴结证的代表方为五味消毒饮（C错）；暑湿浸淫证的代表方为清暑汤（D错）；体虚毒恋，脾胃虚弱证的代表方为五神汤合参苓白术散加减（B错）。竹叶黄芪汤功效清热养阴，益气生津，为有头疽阴虚火炽证代表方（E错）。